不属于单纯窒息性气体的是
A. 氮气
B. 二氧化碳
C. 甲烷
D. 硫化氢

正确答案：D。硫化氢

解析：本题考查单纯窒息性气体。单纯窒息性气体本身无毒，或毒性很低，或为惰性气体，但由于它们的存在使空气中氧的比例和含量明显降低，相应地进入呼吸道、血液和组织细胞的氧含量也降低，导致机体缺氧、窒息的气体。如氮（A对）、氢、甲烷（C对）、乙烷、丙烷、丁烷、乙烯、乙炔、二氧化碳（B对）、水蒸气以及氦、氖、氩等惰性气体。硫化氢（D错，为本题正确答案）属于化学窒息性气体，化学窒息性气体是指进入机体后可对血液或组织产生特殊化学作用，使血液对氧的运送、释放或组织利用氧的能力发生障碍，引起组织细胞缺氧窒息的气体。